患者为老年女性，68岁，心悸不宁，心烦少寐，头晕目眩，手足心热，盗汗耳鸣，舌红少苔，脉细数。首选的治疗药物是
A. 人参养荣汤合桃红四物汤
B. 生脉散合酸枣仁汤
C. 三子养亲汤
D. 天王补心丹
E. 桂枝甘草龙骨牡蛎汤合金匮肾气丸

正确答案：D。天王补心丹

解析：心失濡养故见心悸不宁；虚火扰心，神不守舍故见心烦少寐，头晕目眩，阴不制阳，虚热内生故见手足心热，盗汗，耳鸣，舌红，少苔，脉细数（D对）。人参养荣汤合桃红四物汤治疗气虚血瘀证（A错）。生脉散合酸枣仁汤治疗气阴两虚证（B错）。三子养亲汤具有温肺化痰，降气消食之功效。主治痰壅气逆食滞证（C错）。桂枝甘草龙骨牡蛎汤合金匮肾气丸治疗心阳不振证（E错）。